干燥过程中，可溶性成分在颗粒内部迁移时，片剂会出现
A. 含量不均匀
B. 硬度不够
C. 色斑
D. 裂片
E. 崩解迟缓

正确答案：C。色斑

解析：本题考查片剂的干燥。干燥过程中，颗粒内部的可溶性成分迁移所造成的主要问题是片面上产生色斑（C对）。在干燥过程中，当片剂中含有可溶性色素时，大部分色素迁移到颗粒的外表面（内部的颜色很淡），压成的片剂表面会形成很多“色斑”。